临床诊治工作的基本道德原则是
A. 及时有效最优自主保密
B. 及时有效择优尊重保密
C. 及时准确有效择优自主
D. 及时准确最优保密自主
E. 及时准确择优尊重保密

正确答案：C。及时准确有效择优自主

解析：在临床诊疗中要同时遵循及时、准确准则。及时准则就是要求医务人员力争尽早、尽快地对疾病做出分析判断。早确诊才能早治疗，才能取得事半功倍的效果。准确准则，就是要求医务人员积极充分地利用现实条件，严肃认真地做出符合病情实际的判断。疾病的治疗包括药物治疗、手术治疗、心理治疗等方法。各种治疗方法的效果都与医务人员的技术和医德水平密切关系。因此，医务人员应严格地遵守治疗中的医德要求，在治疗中应贯彻最优化准则。最优化准则是指在选择和实施治疗方案时，医务人员尽可能用最小代价取得最大效果，使治疗达到最佳程度（C对）。